妊娠期妇女口腔治疗的就诊时机说法中错误的是
A. 妊娠期前3个月，口腔治疗一般仅限于处理急症
B. 妊娠期前3个月，避免X线照射
C. 妊娠4～6个月，不可拍照X线片
D. 妊娠4～6个月，不要直接照射盆腔和腹部
E. 妊娠4～6个月是治疗口腔疾病的适宜时期

正确答案：C。妊娠4～6个月，不可拍照X线片

解析：在怀孕早期和晚期接受复杂口腔治疗，会因为紧张和疼痛增加胎儿流产或早产的风险。妊娠期前3个月，口腔治疗一般仅限于处理急症，避免X线照射；妊娠4～6个月是治疗口腔疾病的适宜时期，这个阶段母体处于较稳定的时期，若有未处理或正在治疗中的口腔疾病，应抓紧时间进行治疗，但也应注意在保护措施下拍照X线片，不要直接照射盆腔和腹部；妊娠期后3个月则应尽可能避免口腔治疗，如果发现有口腔疾病，应以保守治疗为主，不可接受拔牙及长时间复杂的根管治疗等创伤性治疗，以免引起早产。急症需治疗时，应选择不含肾上腺素等收缩血管的药物进行局部麻醉。掌握“妊娠期妇女口腔保健”知识点。